以下关于颊间隙解剖特点的描述中，正确的是
A. 位于颊肌与咬肌之间
B. 前界为咬肌前缘
C. 后界为下颌支前缘及颞肌前缘
D. B+C
E. A+B+C

正确答案：E。A+B+C

解析：本题考查面侧深区及颌面部各间隙的境界。颊间隙有广义和狭义之分，本题主要考查狭义。狭义的颊间隙指咬肌与颊肌之间的一个狭小筋膜间隙，即颊间隙位于颊肌与咬肌之间。前界为咬肌前缘，后界为下颌支前缘及颞肌前缘。